先兆子宫破裂表现不包括
A. 下腹部有压痛
B. 大便失禁
C. 烦躁不安
D. 感宫缩过强
E. 排尿困难

正确答案：B。大便失禁

解析：先兆子宫破裂常见于产程长，有梗阻性难产因素的产妇，因胎先露部下降受阻，子宫呈强直性或痉挛性过强收缩，子宫体部增厚变短，子宫下段变薄拉长，两者间形成环状凹陷，随着产程进展，该环逐渐上升达脐平或脐上，称为病理性复环，此时，子宫下段压痛明显（A对），产妇烦躁不安（C对），呼吸、心率加快，下腹疼痛难忍，出现少量阴道流血，膀胱受压充血，出现排尿困难（E对）及血尿，因宫缩过强（D对）、过频，胎体触不清，胎心率加快或减慢或听不清。大便失禁（B错，为本题正确答案）并不属于先兆子宫破裂的临床表现。